某女，48岁。夜不能寐，虚烦不安，健忘，盗汗，舌红少苔，脉数细。宜采用的治法是
A. 健脾养心
B. 疏肝解郁
C. 清心泻火
D. 滋阴养血
E. 益气养血

正确答案：D。滋阴养血

解析：本题考查阴血亏虚证的治法。患者为阴血亏虚证，宜采用的治法是滋阴养血（D对）。阴血亏虚证【症状】夜不能寐，虚烦不安，健忘，盗汗，舌红少苔，脉数细。【治法】滋阴养血。郁证之心脾两虚证【症状】情绪不宁，多思善疑，头晕神疲，心悸胆怯，失眠健忘，食少纳呆，面色不华。舌质淡，苔薄白，脉细。【治法】健脾养心（A错），补益气血。胃痛之肝气犯胃证【症状】胃脘胀痛，痛连两胁，遇烦恼则痛作或痛甚，嗳气、矢气则舒，脘闷嗳气，善太息，大便不畅。舌淡红，苔薄白，脉弦。【治法】疏肝解郁（B错），理气止痛。不寐之肝火扰心证【症状】不寐多梦，甚则彻夜不眠，急躁易怒，伴头晕头胀，目赤耳鸣，口干而苦，不思饮食，便秘溲赤。舌红苔黄，脉弦而数。【治法】疏肝泻火，镇心安神（C错）。中风之气虚血瘀证【症状】肢体偏枯不用，肢软无力，面色萎黄。舌质淡紫或有瘀斑，苔薄白，脉细涩或细弱。【治法】益气养血（E错），化瘀通络。